与子宫颈癌的发生有关的是
A. 人乳头瘤病毒
B. 森林脑炎病毒
C. 巨细胞病毒
D. 狂犬病病毒
E. 柯萨奇病毒

正确答案：A。人乳头瘤病毒